年龄和性别因索（素）属于
A. 疾病发生的原因
B. 疾病发生的条件
C. 两者均有
D. 两者均无
E. 无

正确答案：B。疾病发生的条件

解析：年龄和性别也可作为某些疾病发病的条件（B对），例如小儿易患呼吸道和消化道传染病，这可能与小儿呼吸道、消化道的解剖生理特点和防御功能不够完善有关。妇女易患胆石病、癒症以及甲状腺功能亢进等疾病，而男子则易患动脉粥样硬化、胃癌等疾病。